下列各药中，入汤剂宜包煎的药物是
A. 砂仁
B. 沉香
C. 磁石
D. 五灵脂
E. 天南星

正确答案：D。五灵脂

解析：该题考查特殊煎药方法。包煎（P44）：主要指那些粘性强、粉末状及带有绒毛的药物…如蛤粉、滑石、青黛、旋覆花、车前子、蒲黄、及灶心土等。五灵脂为干燥粪便，煎服会溶解进入汤剂，影响口感，故包煎。（D对ABCE错）。